不是浅静脉的是
A. 股静脉
B. 阴部外静脉
C. 小隐静脉
D. 肘正中静脉
E. 贵要静脉

正确答案：A。股静脉

解析：股静脉（A错，为本题正确答案）为下肢深静脉，不属于浅静脉。阴部外静脉（B对）、小隐静脉（C对）为下肢浅静脉。肘正中静脉（D对）、贵要静脉（E对）为上肢浅静脉。